需要留验检疫和医学观察的时限取决于传染病的
A. 传染期
B. 恢复期
C. 临床症状期
D. 不稳定期
E. 潜伏期

正确答案：E。潜伏期

解析：需要留验检疫和医学观察的时限取决于传染病的潜伏期（E对）。潜伏期的流行病学意义：①判断患者受感染的时间，借此追踪传染源，寻找传播途径：②确定接触者的留验、检疫和医学观察的时限：③确定免疫接种时间：④评价预防措施效果。传染期（A错）的流行病学意义在于它是决定传染病病人隔离期限的重要依据。恢复期（B错）期间体内可能还有残余的病理改变或生化改变，病原体尚未完全清除。临床症状期（C错）是传染病患者临床表现最明显的时期，此期间的特征性表现有一定的诊断意义。传染病没有不稳定期（D错）。